男性，45岁，近2个月出现肝区疼痛。乏力，消瘦明显。消化不良，腹胀，食欲减退。无黄疸，查体：肝于右肋下可触及3.0cm，移动浊音（-），诊断肝癌。对诊断有重要意义的实验室检查
A. 血常规
B. 肝炎系列
C. 肝功能
D. AFP
E. 血浆蛋白测定

正确答案：D。AFP

解析：甲胎蛋白是诊断肝细胞癌特异性的标志物，广泛用于肝癌的普查、诊断、判断治疗效果及预测复发。在排除妊娠和生殖腺胚胎瘤的基础上AFP>400ng/ml为诊断肝癌的条件之一（D对）。